十二指肠上部是形成网膜孔的
A. 上界
B. 下界
C. 内侧界
D. 前界
E. 后界

正确答案：B。下界

解析：网膜孔上界（A错）为肝尾状叶，下界(B对)为十二指肠上部，前界（D错）为肝十二指肠韧带，后界（E错）为覆盖在下腔静脉表面的腹膜。